成人牙髓坏死需行
A. 直接盖髓术
B. 间接盖髓术
C. 牙髓切断术
D. 根管治疗术
E. 根尖诱导成形术

正确答案：D。根管治疗术

解析：牙髓坏死需行根管治疗术。掌握“牙髓坏死、牙髓钙化与牙内吸收”知识点。